男，35岁。CT检查：纵隔的后下部有一5cm×3cm的边界清晰的肿块。手术切除该肿块时最可能损伤的后纵隔结构是
A. 主动脉弓
B. 胸腺
C. 胸交感干
D. 膈神经
E. 上腔静脉

正确答案：C。胸交感干

解析：患者青年男性，CT示后纵隔有一5cm×3cm的边界清晰的肿块，考虑神经源性肿瘤可能性大，神经源性肿瘤多起源于交感神经，手术切除该肿块时最可能损伤的后纵隔结构是胸交感干（C对）。